出现脂肪管型疾病是
A. 肾病综合征
B. 肾结石
C. 尿道炎
D. 急性膀胱炎
E. 肾盂肾炎

正确答案：A。肾病综合征

解析：脂肪管型常见于肾病综合征、慢性肾炎急性发作、中毒性肾病等（A对）。肾结石尿中多见结晶体（B错）。尿道炎尿常规检查见白细胞计数增多或呈脓尿，伴有红细胞增多，少数呈肉眼血尿（C错）。急性膀胱炎尿常规多见白细胞增多，无管型（D错）。肾盂肾炎多见白细胞管型（E错）。